直接从事供、管水的人员不包括下面哪类人员
A. 从事净水人员
B. 从事取样人员
C. 从事化验人员
D. 二次供水卫生管理及水池，水箱清洗人员
E. 从事供水管道维修人员

正确答案：E。从事供水管道维修人员